可促进IgE生成的细胞因子是
A. IL-2
B. IFN-r
C. IL-4
D. SCF
E. IL-10

正确答案：C。IL-4

解析：IL-4使B细胞活化、增殖、可促进IgE生成，可促进肥大细胞、嗜酸性粒细胞和嗜碱性粒细胞发育。掌握“细胞因子及受体”知识点。